下列关于健康教育与健康促进计划评价的叙述，不正确的是
A. 评价是将客观实际与目标进行比较的过程
B. 评价可保证计划执行的质量
C. 评价通常在项目的总结阶段进行
D. 评价的方法之一是建立监测系统
E. 评价可改进专业人员的工作

正确答案：D。评价的方法之一是建立监测系统